陈旧性肛裂伴肛管狭窄者手术时多选用
A. 扩肛法
B. 纵切横缝法
C. 肛裂侧切术
D. 切开疗法
E. 挂线疗法

正确答案：B。纵切横缝法

解析：扩肛法：适用于早期肛裂，无结缔组织外痔、肛乳头肥大等合并症者（A错）。纵切横缝法：适用于陈旧性肛裂伴有肛管狭窄者（B对）。肛裂侧切术：适用于不伴有结缔组织外痔、皮下漏等陈旧性肛裂（C错）。切开疗法：适用于陈旧性肛裂伴有结缔组织外痔、乳头肥大等（D错）。挂线疗法：适用于距离肛门4cm以内，有内外口的低位肛瘘；亦作为复杂性肛瘘切开疗法或切除疗法的辅助方法（E错）。